主治阴虚，骨蒸潮热，功能退虚热，凉血的药物有
A. 青蒿
B. 银柴胡
C. 白薇
D. 牡丹皮
E. 地骨皮

正确答案：A、C、D、E。青蒿；白薇；牡丹皮；地骨皮

解析：本题考查的是青蒿、白薇、牡丹皮与地骨皮的功效与主治病证。主治阴虚，骨蒸潮热，功能退虚热，凉血的药物有青蒿（A对）、白薇（C对）、牡丹皮（D对）与地骨皮（E对）。青蒿：【功效】退虚热，凉血，解暑，截疟。【主治病证】（1）阴虚发热，骨蒸潮热，虚热兼表。（2）热病后期之夜热早凉，或低热不退。（3）血热疹痒、吐血、衄血。（4）疟疾寒热。（5）暑热外感，暑热烦渴。白薇：【功效】退虚热，凉血清热，利尿通淋，解毒疗疮。【主治病证】（1）阴虚发热，骨蒸潮热，产后虚热，阴虚外感。（2）温病热入营血证，肺热咳嗽。（3）热淋，血淋。（4）痈肿疮毒，咽喉肿痛，毒蛇咬伤。牡丹皮：【功效】清热凉血，活血散瘀，退虚热。【主治病证】（1）温病热入血分而发斑疹，血热吐血、衄血。（2）温病后期阴虚发热，久病伤阴之无汗骨蒸。（3）血滞之闭经、痛经，产后瘀阻，癥瘕，跌打伤肿。（4）痈肿疮毒，肠痈腹痛。地骨皮：【功效】退虚热，凉血，清肺降火，生津。【主治病证】（1）阴虚发热，有汗骨蒸，小儿疳热。（2）血热之吐血、衄血、尿血。（3）肺热咳嗽。（4）内热消渴。银柴胡（B错）：【功效】退虚热，清疳热。【主治病证】（1）阴虚发热，骨蒸劳热。（2）小儿疳热。